排泄的主要方式是哪三个
A. 肾、肝、汗液
B. 汗液、肺、粪便
C. 肺、粪便、肾
D. 粪便、肾、汗液

正确答案：C。肺、粪便、肾

解析：本题考查排泄的主要方式。排泄是指化学毒物经由不同途径排出体外的过程。其主要方式是肺、粪便、肾（C对ABD错）三种。